Crohn病的病变大多位于
A. 空肠
B. 末段回肠
C. 回盲部
D. 全结肠
E. 直肠乙状结肠

正确答案：B。末段回肠

解析：Crohn病（克罗恩病）可累及全消化道，为非连续性全层炎症，最常累及末段回肠（B对）。回盲部（C错）是肠结核的好发部位（P368）；直肠乙状结肠（E错）是溃疡性结肠炎的好发部位（P373）。